玉屏风散与牡蛎散相同的功用是
A. 固表
B. 涩肠
C. 止遗
D. 固冲
E. 补肾

正确答案：A。固表

解析：本题考查玉屏风散与牡蛎散的功用，属于记忆内容。玉屏风散功用益气固表止汗。牡蛎散功用敛阴止汗，益气固表。益气固表止汗是二者的共同功效（A对）。